复合树脂备洞时，洞缘斜面的倾斜角度为
A. 15度
B. 30度
C. 45度
D. 70度
E. 90度

正确答案：C。45度

解析：复合树脂粘接修复术的洞缘釉质壁制备成45°角的短斜面，以加宽釉质酸蚀刻带。掌握“树脂粘结概念及釉质、牙本质粘结”知识点。